急性磨牙冠周炎的治疗方法中应除外
A. 局部冲洗上药
B. 切开引流
C. 配合口服抗生素
D. 拔除患牙
E. 使用漱口液

正确答案：D。拔除患牙

解析：急性炎症期一般不能拔牙，以免感染扩散。若急性冠周炎引起张口受限，则牙齿无法拔除。掌握“下颌智齿冠周炎”知识点。